卵圆窝
A. 在左心房的后壁
B. 在室间隔的左面
C. 在室间隔的右面
D. 在房间隔的右房侧
E. 在房间隔的左房侧

正确答案：D。在房间隔的右房侧

解析：在房间隔的右房侧（D对）有一卵圆形凹陷称卵圆窝，是胚胎时期卵圆孔闭合后的遗迹，此处薄弱，是房间隔缺损的好发部位。